循环性缺氧可由下列哪种原因引起？
A. 吸入气氧分压降低
B. 血中红细胞数减少
C. 组织缺血或淤血
D. CO中毒
E. 肺泡弥散到循环血液中的氧减少

正确答案：C。组织缺血或淤血

解析：循环性缺氧是指因组织血流量减少使组织供氧量减少所引起的缺氧，又称为低血流性缺氧或低动力性缺氧。组织缺血或淤血（C对）是引起循环性缺氧的原因。吸入气氧分压减少（A错）、CO中毒（D错）、肺泡弥散到循环血液中的氧减少（E错）是引起乏氧性缺氧的原因。血中红细胞数减少（B错）是引起血液性缺氧的原因。